某女，73岁，10年前患风湿性关节炎，反复发作。1月前又患急性肝炎。刻下双膝关节红肿热痛、目珠黄染、尿黄，舌红、苔黄腻。证属风湿热痹、湿热黄疸，宜选用的药是
A. 独活
B. 秦艽
C. 青风藤
D. 豨莶草
E. 臭梧桐

正确答案：B。秦艽

解析：本题考查秦艽的主治病证。证属风湿热痹、湿热黄疸，宜选用的药是秦艽（B对）。秦艽【功效】祛风湿，舒筋络，清虚热，利湿退黄。【主治病证】（1）风湿热痹，风寒湿痹，表证夹湿。（2）骨蒸潮热。（3）湿热黄疸。独活（A错）【功效】祛风湿，止痛，解表。【主治病证】（1）风寒湿痹，腰膝酸痛。（2）表证夹湿。（3）少阴头痛，皮肤湿痒。青风藤（C错）【功效】祛风湿，通经络，利小便。【主治病证】（1）风湿痹痛，关节肿胀，拘挛麻木。（2）脚气浮肿。豨莶草（D错）【功效】祛风湿，通经络，清热解毒，降血压。【主治病证】（1）风湿痹痛，肢体麻木。（2）中风手足不遂。（3）痈肿疮毒，湿疹瘙痒。（4）高血压病。臭梧桐（E错）【功效】祛风湿，通经络，降血压。【主治病证】（1）风湿痹痛。（2）肢体麻木，半身不遂。（3）湿疹瘙痒（外洗）。（4）高血压病。